某男，45岁。1年来，潮热盗汗、口干咽痛，耳鸣遗精、小便短赤。证属阴虚火旺，宜选用的成药是
A. 七宝美髯丸
B. 桂附地黄丸
C. 知柏地黄丸
D. 济生肾气丸
E. 人参归脾丸

正确答案：C。知柏地黄丸

解析：本题考查的是知柏地黄丸的主治。某男，45岁。1年来，潮热盗汗、口干咽痛，耳鸣遗精、小便短赤。证属阴虚火旺，宜选用的成药是知柏地黄丸（C对）。知柏地黄丸：【主治】阴虚火旺，潮热盗汗，口干咽痛，耳鸣遗精，小便短赤。七宝美髯丸（A错）【主治】肝肾不足所致的须发早白、遗精早泄、头眩耳鸣、腰酸背痛。桂附地黄丸（B错）：【主治】肾阳不足，腰膝酸冷，肢体浮肿，小便不利或反多，痰饮喘咳，消渴。济生肾气丸（D错）：【主治】肾阳不足、水湿内停所致的肾虚水肿、腰膝酸重、小便不利、痰饮咳喘。人参归脾丸（E错）：【主治】心脾两虚、气血不足所致的心悸、怔忡、失眠健忘、食少体倦、面色萎黄，以及脾不统血所致的便血、崩漏、带下。